腺病毒肺炎可出现
A. 肺部体征出现较早，易引起肺脓肿、肺大疱
B. 体温一般不高，喘憋为主，肺部听诊有哮鸣音
C. 多为稽留热，肺部体征出现晚
D. 嗜酸细胞增高
E. X线检查示肺部片状阴影，呈云雾状或游走性

正确答案：C。多为稽留热，肺部体征出现晚

解析：腺病毒肺炎，起病急，表现为稽留高热，肺部体征出现较晚（C对）。好发于病毒性疾病流行季节，症状通常较轻，起病缓慢，起初有数天至一周的无症状期，继而乏力、头痛、咽痛、肌肉酸痛，咳嗽明显，多为发作性干咳，夜间为重，也可产生脓痰。本病常无显著的胸部体征，病情严重者有呼吸浅速、心率增快、肺部干湿性啰音（AB错）。血液检查白细胞计数一般正常，也可稍高或稍低，重症者常有淋巴细胞及血小板减少，嗜酸性粒细胞无异常（升高多见于过敏性疾病、寄生虫疾病、免疫疾病、血液病、某些恶性肿瘤等）（D错）。胸部X线征象常常与症状不相称，往往症状严重而无明显的X线表现，腺病毒肺炎局部有效点状、不规则网状阴影，可融合成片状浸润灶。X线检查示肺部片状阴影，呈云雾状或游走性（E错）为支原体肺炎X 线检查特点。